MHC分子对抗原的交叉提呈是
A. MHCⅠ类分子途径
B. MHCⅡ类分子途径
C. 非经典的抗原提呈途径
D. 脂类抗原的CD1分子提呈途径
E. 经典的抗原提呈途径

正确答案：C。非经典的抗原提呈途径